含脏器提取物且不含中药材原粉的制剂，按照非无菌中药制剂微生物限度标准的要求,每10g或10ml不得检出
A. 白色念珠菌
B. 铜绿假单胞菌
C. 金光色葡萄球菌
D. 沙门菌
E. 耐胆盐革兰阴性菌

正确答案：D。沙门菌

解析：本题考查中药材的质量要求。含脏器提取物且不含中药材原粉的制剂，按照非无菌中药制剂微生物限度标准的要求，每10g或10ml不得检出沙门菌（D对）。山豆根的药理作用：山豆根有抗肿瘤作用，其所含苦参碱、氧化苦参碱对实验性肿瘤均呈抑制作用，山豆根具有抗炎、镇痛、解热作用，且对金黄色葡萄球菌（C错）、痢疾杆菌、大肠埃希菌、结核杆菌、霍乱弧菌、麻风杆菌、絮状表皮癣菌、白色念珠菌（A错）以及钩端螺旋体均有抑制作用；此外，山豆根还有抗心律失常和保肝作用。微生物限度：除另有规定外，按《中国药典》非无菌产品微生物限度检查：微生物计数法和控制菌检查法及非无菌药品微生物限度标准检查，凝胶贴膏应符合规定，橡胶贴膏每10cm2不得检出金黄色葡萄球菌和铜绿假单胞菌（B错）。肉桂的药理作用：肉桂具有抗消化性溃疡、止泻、利胆作用，也有降血糖、降血脂等作用。肉桂中原花青素成分具有抗糖尿病的药理作用。肉桂醛占肉桂挥发油总量的80%左右，具有很强的杀菌作用，现代研究表明，肉桂挥发油对革兰阳性菌及革兰阴性菌（E错）均有良好的体外抑菌效果。